含有一般内脏运动纤维的是
A. 三叉神经
B. 副神经
C. 舌咽神经
D. 舌下神经
E. 位听神经

正确答案：C。舌咽神经

解析：舌咽神经（C对）含有5种纤维成分：特殊内脏运动纤维、一般内脏运动纤维、一般内脏感觉纤维、特殊内脏感觉纤维、一般躯体感觉纤维。三叉神经（A错）含一般躯体感觉和特殊内脏运动两种纤维。副神经（B错）为运动性神经，含特殊内脏运动纤维。舌下神经（D错）为运动性神经，含一般躯体运动纤维。位听神经（E错），由传导平衡觉的前庭神经和传导听觉的蜗神经两部分组成。